下列方剂中,具有清胃热,滋肾阴功效的是
A. 玉女煎
B. 清胃散
C. 苇茎汤
D. 泻白散
E. 龙胆泻肝汤

正确答案：A。玉女煎

解析：具有清胃热,滋肾阴功效的方剂是玉女煎，主治少阴不足，阳明有余之证，本方为治疗胃热阴虚牙痛的常用方（A对）。清胃散功用清胃凉血（B错）。苇茎汤的功用清肺化痰，逐瘀排脓（C错）。泻白散功用清泻肺热，止咳平喘（D错）。龙胆泻肝汤功用清泻肝胆实火，清利肝经湿热（E错）。